梅毒螺旋体感染可引起
A. 黄疸出血症状
B. 咽峡炎
C. 关节炎及关节畸形
D. 脊髓痨及动脉瘤
E. 反复发热与缓解

正确答案：D。脊髓痨及动脉瘤

解析：黄疸出血症状（A错）可由钩端螺旋体感染引起，咽峡炎（B错）可由溶血性链球菌引起，关节炎关节畸形（C错）多见于风湿性疾病，反复发热与缓解（E错）可见于疟疾，梅毒螺旋体感染可引起脊髓痨及动脉瘤（D对）。